属于东方膳食结构特点的是
A. 食用海产品较多
B. 谷类食物消费量很小
C. 食用畜肉较多
D. 易出现能量过剩
E. 膳食纤维充足

正确答案：E。膳食纤维充足

解析：本题考查东方膳食结构的特点。东方膳食结构的特点是谷物食物消费量大（B错），动物性食物消费量小（C错），植物性食物提供的能量占总能量近90%，动物性蛋白质一般少于蛋白质总量的10%～20%。平均每天能量摄入为2000～2400kcal，蛋白质仅50g左右，脂肪仅30～40g，膳食纤维充足（E对A错），来自动物性食物的营养素如铁、钙、维生素A的摄入量常会出现不足。这类膳食容易出现蛋白质、能量营养不良（D错），以致体质较弱，健康状况不良，劳动能力降低，但心血管疾病（冠心病、脑卒中）、2型糖尿病肿瘤等慢性病的发病率较低。